化妆品与外用药品的主要区别
A. 使用的部位不同
B. 获取的渠道不同
C. 涂抹的方式不同
D. 剂量和时间上的不同
E. 剂型的不同

正确答案：D。剂量和时间上的不同

解析：本题考查化妆品与外用药品的主要区别。化妆品是指以涂擦、喷洒或其他类似方法，散布于人体表面（皮肤、毛发、指甲、口唇等）、牙齿以及口腔黏膜，以清洁、保护、美化、修饰以及保持其处于良好状态为目的的产品。外用药品是指在体表或某些粘膜部位应用，具有杀虫止痒、消肿散结、化腐排脓、生肌收口、收敛止血的一些药物。化妆品与外用药品的主要区别是剂量和时间上的不同（D对ABCE错），化妆品使用没有剂量和时间的限制，而外用药品使用有剂量和时间的限制。